患者呼吸急促，喉中哮鸣有声，胸膈满闷，咳嗽痰少，形寒畏冷，舌苔白滑，脉弦紧。其治法是
A. 温肺化痰，纳气平喘
B. 温肺散寒，化痰平喘
C. 温肺散寒，止咳化痰
D. 温肺化痰，散寒解表
E. 散寒温脾，化痰平喘

正确答案：B。温肺散寒，化痰平喘

解析：根据“呼吸急促，喉中哮鸣有声”可知病为“哮病”；根据“咳嗽痰少，形寒畏冷，舌苔白滑，脉弦紧”辨为“寒哮”，该证机理为寒邪侵袭，内合于肺，“伏痰”遇感引触，痰随气升，气因痰阻，相互搏结，壅塞气道。治疗应以温肺散寒，化痰平喘为法（B对）。